下列中国古代医德思想中不包括
A. 仁爱救人，赤诚济世的事业准则
B. 不图名利，清廉正直的道德品质
C. 探索研究，大胆创新的敬业精神
D. 一心救治，不畏艰苦的服务态度
E. 不畏权势，忠于医业的献身精神

正确答案：C。探索研究，大胆创新的敬业精神

解析：中国医学道德的优良传统：仁爱救人，赤诚济世的行医宗旨。不图名利，清廉正直的道德品质。普同一等，一心赴救的服务态度。尊重同道，谦和不矜的医疗作风。注重自律，忠于医业的献身精神（C对）。